下列属于下颌支结构的是
A. 髁突
B. 颏结节
C. 内斜线
D. 下颏棘
E. 正中联合

正确答案：A。髁突

解析：下颌支：又称下颌升支，其上端有喙突和髁突（关节突），喙突上有颞肌和咬肌附丽，髁突颈部下方有翼外肌下头附着：两突之间有下颌切迹（乙状切迹）。掌握“下颌骨及腭骨解剖特点”知识点。